清热药药理作用，不包括
A. 解热
B. 抗炎
C. 延缓衰老
D. 抗肿瘤
E. 调节免疫

正确答案：C。延缓衰老

解析：本题考查的是清热药的药理作用。清热药药理作用，不包括延缓衰老（C错，为本题正确答案）。清热药的药理作用包括抗病原体，抗毒素，抗炎（B对），解热（A对），对免疫功能的影响（E对），抗肿瘤（D对），镇静，降压，保肝，利胆等。